有权批准医疗机构配制临床需要而市场无供应的麻醉药品和精神药品制剂的部门是
A. 省级卫生行政部门
B. 社区的市级药品监督管理部门
C. 省级药品监督管理部门
D. 社区的市级卫生行政部门
E. 县级卫生行政部门

正确答案：C。省级药品监督管理部门

解析：《药品管理法》规定，医疗机构配制制剂应当是本单位临床需要而市场上没有供应的品种，并须经所在地省、自治区、直辖市人民政府药品监督管理部门批准后方可配置。有权批准医疗机构配制临床需要而市场无供应的麻醉药品和精神药品制剂的部门是省级药品监督管理部门（C对）。